以下健康调查中有关调查对象的选择条件哪一条是错误的
A. 居住年限不少于5年
B. 尽量避免职业暴露
C. 尽可能选择高暴露人群
D. 不可选择老人、小孩等体弱人群
E. 对照人群除暴露情况与研究人群不同外，其他条件应大致相同

正确答案：D。不可选择老人、小孩等体弱人群

解析：本题考查健康调查中调查对象的选择条件。人群健康调查中应选择居住年限不少于5年（A对），暴露机会多的人群（C对）作为调查对象，甚至可选择老人、儿童等易感人群（D错，为本题正确答案）。应避免职业暴露（B对）、服用药物、吸烟、饮酒等嗜好、室内空气污染等混杂因子的干扰。对照人群也必须同样按上述要求严格选定，而且在性别、年龄、居住年限、职业种类、生活居住条件、生活习惯、经济水平等均应大致相同（E对）。